某肺心病、呼吸衰竭合并肺性脑病患者，用利尿剂和激素等治疗；血气分析结果为：pH7.43,PaCO₂8.13kPa(61mmHg),HCO₃⁻38mmol/L血Na⁺140mmo1/L.CL⁻74mmo1/l,K⁺3.5mmol/L,其酸碱紊乱类型为
A. 呼吸性酸中毒
B. 呼吸性酸中毒合并AG增高性代谢性酸中毒和代谢性碱中毒
C. 呼吸性酸中毒合并代谢性碱中毒
D. 呼吸性酪中毒合并AG正常性代谢性酸中毒和代谢性碱中毒
E. AG增高性代谢性酸中毒合并代谢性碱中毒

正确答案：B。呼吸性酸中毒合并AG增高性代谢性酸中毒和代谢性碱中毒

解析：该患者PaC02 原发性增高，为慢性呼吸性酸中毒，计算HC03-代偿预计值应为31.4±3mmol/L,实测值为38mmoVL,表示有代谢性碱中毒存在。计算AG值，AG=140-38-74=28, 明显升高，提示患者还有代谢性酸中毒存在，故该患者为三重性酸碱平衡紊乱，即呼吸性酸中毒合并AG增高性代谢性酸中毒和代谢性碱中毒（B对）。